小儿腹泻中重度脱水伴低血钾时应
A. 立即快速给予补钾
B. 纠正脱水不必补钾
C. 纠正脱水同时以0.5%浓度缓慢补钾
D. 口服氯化钾
E. 纠正酸中毒同时缓慢补钾

正确答案：E。纠正酸中毒同时缓慢补钾

解析：小儿腹泻中重度脱水伴低血钾时应纠正酸中毒同时缓慢补钾（E对），由于重型腹泻病时常出现代谢性酸中毒、低钾血症，所以小儿腹泻补液时应该纠酸、补钾、补钙、补镁，且补液需要定量、定性、定速。 静脉补钾时应精确计算补充的速度与浓度，即使在严重低钾病入快速补钾（A错）也有潜在危险，包括引起致死性心律失常。若只纠正脱水而不补钾（B错）会进一步加重低钾血症，应补钾同时积极治疗原发病。补钾常以静脉输入，小儿很难配合口服补钾（D错），静脉补钾浓度不能超过0.3%（C错）。